具有组胺H₁受体拮抗作用的镇痛药是
A. 纳洛酮
B. 布托啡诺
C. 盐酸布桂嗪
D. 磷酸可待因
E. 苯噻啶

正确答案：E。苯噻啶